女，65岁。右侧胸部闭合性损伤2天。右胸疼痛，咳嗽时加重，无呼吸困难。胸壁皮肤无破损，局部皮下淤血。胸部X线片示右侧第6肋骨单处骨折，右侧气胸压缩40%。最恰当的治疗措施是
A. 开胸探查
B. 胸壁切开，肋骨内固定
C. 胸壁包扎固定、镇痛
D. 胸腔闭式引流
E. 静脉滴注抗生

正确答案：D。胸腔闭式引流

解析：老年患者，右侧胸部闭合性损伤2天，右胸痛，咳嗽时加重，无呼吸困难，胸部皮肤无破损，局部皮下淤血，胸部X线片示右侧第6肋骨单处骨折，右侧气胸压缩40%，根据患者的临床症状、体征及实验室检查，考虑最可能的诊断为闭合性气胸合并肋骨骨折，且气胸压缩面积>30%，所以最恰当的治疗方式是胸腔闭式引流（D对），开胸探查（A错）多用于急性肺部损伤，病因不明的患者，该患者的病因已经很明确。胸壁切开，肋骨内固定（B错）肋骨骨折时应避免肋骨固定手术，缩短ICU停留和住院时间，促进病人早日下床活动并降低相关治疗费用。胸壁包扎固定、镇痛（C错）该患者为单根单处肋骨骨折，且疼痛不明显，暂时可不镇痛。静脉滴注抗生素（E错）为一般支持治疗，目前还是需胸腔闭式引流，以免肺萎陷加重。